根据《药品广告审查发布标准》，药品广告宣传中不得出现的是
A. 药品广告上注明了药品生产企业的名称
B. 电视台在早晨6：00播出含有改善性功能的药品广告
C. 药品广告上有负责无效索赔的承诺
D. 处方药广告上有“本广告仅供医学药学专业人员阅读”的忠告语
E. 在某非处方药冠名的商业活动广告上标明该非处方药商品名称

正确答案：C。药品广告上有负责无效索赔的承诺

解析：本题考查广告中不得出现的情形。根据《药品广告审查发布标准》，药品广告宣传中不得出现的是药品广告上有负责无效索赔的承诺（C错，为本题正确答案）。广告中不得出现的情形：药品、医疗器械、保健食品和特殊医学用途配方食品广告不得违反《广告法》第九条、第十六条、第十九条规定，不得包含的内容还包括：①使用或者变相使用国家机关、国家机关工作人员、军队单位或者军队人员的名义或者形象，或者利用军队装备、设施等从事广告宣传；②使用科研单位、学术机构、行业协会或者专家、学者、医师、药师、临床营养师、患者等的名义或者形象作推荐、证明；③违反科学规律，明示或者暗示可以治疗所有疾病、适应所有症状、适应所有人群，或者正常生活和治疗病症所必需等内容；④引起公众对所处健康状况和所患疾病产生不必要的担忧和恐惧，或者使公众误解不使用该产品会患某种疾病或者加重病情的内容；⑤含有“安全”“安全无毒副作用”“毒副作用小”；明示或者暗示成分为“天然”，因而安全性有保证等内容；⑥含有“热销、抢购、试用”“家庭必备、免费治疗、免费赠送”等诱导性内容，“评比、排序、推荐、指定、选用、获奖”等综合性评价内容，“无效退款、保险公司保险”等保证性内容，怂患消费者任意、过量使用药品的内容；⑦含有医疗机构的名称、地址、联系方式、诊疗项目、诊疗方法以及有关义诊、医疗咨询电话、开设特约门诊等医疗服务的内容；⑧法律、行政法规规定不得含有的其他内容。